有吸附胆汁的作用，可用于治疗胆汁反流的胃食管反流病的药品是
A. 铝碳酸镁咀嚼片
B. 多潘立酮片
C. 奥美拉唑肠溶胶囊
D. 乳果糖口服溶液
E. 巴氯芬片

正确答案：A。铝碳酸镁咀嚼片

解析：本题考查铝碳酸镁的药理作用。铝碳酸镁（A对）有吸附胆汁的作用，可用于治疗胆汁反流的胃食管反流病。